成组设计多个样本比较的秩和检验，若最小样本例数大于5，统计量H近似服从的分布是
A. t分布
B. 正态分布
C. χ²分布
D. F分布
E. 标准正态分布

正确答案：C。χ²分布